女，34岁，上腹部疼痛3天，右下腹疼痛12小时，体温37.8℃，既往有溃疡病史，拟诊急性阑尾炎行手术探查。术中发现右髂窝内有较多淡黄色混浊液体，阑尾外观无异常。应考虑的原发病为
A. 急性盆腔炎
B. 原发性腹膜炎
C. 单纯性阑尾炎
D. 右侧输尿管结石伴感染
E. 十二指肠壶腹部（球部）溃疡穿孔

正确答案：E。十二指肠壶腹部（球部）溃疡穿孔

解析：青年女性患者，上腹部疼痛3天，右下腹疼痛12小时，体温37.8℃，既往有溃疡病史，拟诊急性阑尾炎行手术探查。术中发现右髂窝内有较多淡黄色混浊液体，阑尾外观无异常。应考虑的原发病为十二指肠壶腹部（球部）溃疡穿孔（E 对），溃疡穿孔后胃内容物可沿右结肠旁沟下流而出现右下腹痛，右髂窝内有较多淡黄色混浊液体，阑尾外观无异常也支持诊断。